除整铸支架可摘局部义齿以外，我国目前可摘局部义齿设计的基本形式是
A. 铸造卡环
B. 锻丝卡环
C. RPI卡环
D. RPA卡环
E. 杆型卡环

正确答案：B。锻丝卡环

解析：锻丝卡环是我国目前除整铸支架可摘局部义齿以外，可摘局部义齿设计的基本形式。掌握“局部义齿固位体”知识点。